根分叉病变的病因不正确的是
A. 菌斑微生物是主要病因
B. (牙合)创伤是促进因素
C. 根柱长的比根柱短的牙易发
D. 髓底副根管是易发因素
E. 牙颈部釉突是易发因素

正确答案：C。根柱长的比根柱短的牙易发

解析：本题考查根分叉病变的病因。根分叉病变的病因不正确的是根柱长的比根桂短的牙易发（C错，为本题正确答案）。牙根的解剖形态是根分叉病变的重要发病因素，根柱较短的牙，根分叉的开口离牙颈部近，一旦发生牙周炎，较易发生根分叉病变；而根柱长者则不易发生根分叉病变，但一旦发生则治疗较困难。根分叉病变的病因：菌斑微生物是主要病因（A对），由于菌斑是牙周病的始动因子，菌斑的存在促进根分叉病变的发展，所以菌斑是根分叉病变的主要致病因素。牙根的解剖形态是根分叉病变的重要发病因素。(牙合)创伤是促进因素（B对），能加速牙周炎的进展。髓底副根管是易发因素（D对），磨牙牙髓感染经髓室底的副根管扩散到根分叉区常见于副根管多的多根牙。牙颈部釉突是易发因素（E对），牙颈部釉质突起处无牙周膜附着仅有结合上皮，故在牙龈有炎症时该处易形成牙周袋。